若患者不能耐受万古霉素时，可选择替代的药物是
A. 阿米卡星
B. 替考拉宁
C. 头孢曲松
D. 头孢哌酮
E. 美罗培南

正确答案：B。替考拉宁

解析：本题考查万古霉素的替代用药。替考拉宁（B对）可作为万古霉素和甲硝唑的替代药。替考拉宁是与万古霉素类似的新糖肽抗生素，其抗菌谱及抗菌活性与万古霉素相似。对金葡菌的作用比万古霉素更强，不良反应更少。